根管治疗中，凡旋转使用的器械，不应该旋转超过
A. 45°
B. 90°
C. 180°
D. 270°
E. 360°

正确答案：C。180°

解析：本题考查根管治疗器械的旋转角度。根管治疗中，凡旋转使用的器械，不应该旋转超过180°（C对），若过度旋转如旋转270°（D错）、360°（E错）易造成器械折断，器械折断是根管治疗中常见并发症，应避免此种情况的发生。K锉在根管内顺指针方向转动时可切削根管壁的牙本质，旋转角度一般为90度-180度（B错）。拔髓针用于拔出根管内牙髓，插入根管1/3处，顺时针旋转不超过180度（A错）。